职业卫生知识与防护措施教育的主要内容不包括
A. 进行心理卫生教育
B. 一般卫生习惯教育
C. 采取正确的作业方式
D. 坚持工间操制度
E. 合理组织、安排生产劳动时间

正确答案：B。一般卫生习惯教育